面瘫的恢复期，应加用
A. 膏肓俞
B. 命门
C. 气海
D. 关元
E. 足三里

正确答案：E。足三里

解析：面瘫恢复期除选取主穴外，因气血已伤，气血不足，不能濡养经脉，应补益气血。膏肓俞主要治疗肺脏虚损（A错）。命门主要治疗肾脏虚损，尤其是阳虚（B错）。气海主要用于治疗冲任的气血不足（C错）。关元主要治疗肾虚（D错）。足三里，行补法可补益气血，濡养经脉（E对）。